关于强心苷的叙述，正确的是
A. 其极性越大，口服吸收率越高
B. 强心苷的作用与交感神经递质及其受体有关
C. 具有正性频率作用
D. 安全范围小，易中毒
E. 可用于室性心动过速

正确答案：D。安全范围小，易中毒

解析：本题考查强心苷。强心苷安全范围小，易中毒（D对）。其用药安全窗很小，轻度中毒剂量约为有效治疗剂量的两倍，心肌在缺血缺氧情况下中毒剂量更小。强心苷类药主要是通过抑制心肌细胞膜上的Na⁺，K⁺-ATP酶（B错）发挥正性肌力作用（C错）。强心苷类药物极性越大，口服吸收率反而越低（A错），且禁用于室性心动过速（E错）。